男，50岁。胃大部切除术后3天出现阵发性腹痛、腹胀，无肛门排气，生命征平稳，最可能的原因是
A. 吻合口炎
B. 腹腔内血肿形成
C. 肠系膜血管缺血性疾病
D. 肠扭转
E. 手术后肠蠕动功能失调

正确答案：E。手术后肠蠕动功能失调

解析：中年男性患者，胃大部切除术后3天，出现阵发性腹痛、腹胀，无肛门排气，最可能的原因是手术后肠蠕动功能失调（E对）。胃肠道蠕动功能失调是剖腹手术后的常见并发症，可表现为腹痛、腹胀、恶心、呕吐、停止自肛门排便排气等症状。吻合口炎（A错）主要表现为上腹部的疼痛或心窝、胸骨后烧灼感，部分患者出现呕吐胆汁，且呕吐后症状未能缓解。由于腹膜有去纤维作用可使血液不凝，因此腹腔内出血一般不会形成腹腔内血肿（B错）。肠系膜血管缺血性疾病（P365）（C错）发病多较急骤，早期表现为突然发生剧烈的腹部绞痛，恶心、呕吐频繁，呕吐物多为血性。肠扭转（P364）（D错）起病时腹痛剧烈且无间歇期，早期即可出现休克。